克汀病是由于缺乏哪种营养素引起的
A. 锌
B. 钙
C. 硒
D. 碘
E. 铁

正确答案：D。碘